常先困脾的邪气是
A. 寒
B. 火
C. 风
D. 燥
E. 湿

正确答案：E。湿

解析：湿与水同类，故属阴邪，阴邪侵人，机体阳气与之抗争，故湿邪侵袭，易伤阳气，故清·叶桂《温热论·外感温热篇》说：“湿胜则阳微”脾主运化水液，性喜燥而恶湿，故外感湿邪，常易困脾，致脾阳不振，运化无权，从而使水湿内停聚，发为泄泻、水肿、痰饮等。《素问·六元正纪大论》说：“湿胜则濡泄，甚则水闭附肿”（E对）。